下列高容量性低钠血症对机体的影响，哪项是不正确的？
A. 细胞外液量增多，血液稀释
B. 细胞内水肿
C. 无中枢神经系统症状
D. 红细胞压积降低
E. 早期尿量增加（肾功能降碍者例外），尿比重下降

正确答案：C。无中枢神经系统症状

解析：水中毒时细胞内外液量均增多，血液稀释（A对），细胞内水肿（B对），尿量增加，尿比重下降（E对）。红细胞压积是指一定量的抗凝全血经离心沉淀后,测得下沉的红细胞占全血的容积比，血容量增加，红细胞压积降低（D对）。脑细胞的肿胀和脑组织水肿使颅内压增高，脑脊液压力也增加，此时可引起各种中枢神经系统受压症状（C错，为本题正确答案）。